抗高血压药最合理的联合是
A. 氢氯噻嗪﹢硝苯地平﹢普萘洛尔
B. 氢氯噻嗪﹢拉贝洛尔﹢普萘洛尔
C. 肼屈嗪﹢地尔硫䓬﹢普萘洛尔
D. 肼屈嗪﹢哌唑嗪﹢普萘洛尔
E. 硝苯地平﹢哌唑嗪﹢可乐定

正确答案：A。氢氯噻嗪﹢硝苯地平﹢普萘洛尔